将β-胡萝卜素制成微囊的目的是
A. 防止其水解
B. 防止其氧化
C. 防止其挥发
D. 减少其对胃肠道的刺激性
E. 增加其溶解度

正确答案：B。防止其氧化

解析：本题考查药物的降解途径。将β-胡萝卜素制成微囊的目的是防止其氧化（B对）。β-胡萝卜素结构中含有多个碳碳双键，在光、热、氧气及活泼性较强的自由基离子存在的条件下易发生氧化，制备成微囊后，降低了对环境中氧气、光线等的敏感性，提高了药物的稳定性。β-胡萝卜素结构中不含有易水解的化学键，所以制成微囊不是为了防止水解（A错）。β-胡萝卜素不易挥发，所以制成微囊不是为了防止挥发（C错）。β-胡萝卜素对胃肠道无刺激性，所以制成微囊不是为了减少对胃肠道的刺激性（D错）。制成微囊是为了防止其被氧化，与溶解度大小无关（E错）。